千金子的别名是
A. 坤草子
B. 续随子
C. 大腹子
D. 鼠粘子
E. 莱菔子

正确答案：B。续随子

解析：本题考查的是常见的饮片正名与相关别名。千金子的别名是续随子（B对）。千金子别名：续随子。坤草子（A错）为茺蔚子的别名。茺蔚子别名：益母草子、坤草子。大腹子（C错）为槟榔的别名。槟榔别名：花槟榔、大腹子、海南子。鼠粘子（D错）为牛蒡子的别名。牛蒡子别名：大力子、鼠黏子、牛子、恶实。莱菔子（E错）为中药饮片的正名。莱菔子别名：萝卜子。